“行痹”的病邪是
A. 湿邪
B. 火邪
C. 风邪
D. 寒邪
E. 暑邪

正确答案：C。风邪

解析：行痹的临床表现为肢体酸痛，痛而游走无定处；病因风寒湿三邪中以风邪偏胜，而风邪易于游走所致（C对）。寒邪为最易导致疼痛的外邪，即寒邪致病致病易成“痛痹”（D错）。湿邪致病易形成着痹（A错）。